室内外共存同类污染物发生源时，该污染物的
A. 室内浓度往往是低于室外浓度
B. 室内浓度往往是与室外浓度相等
C. 室内浓度往往是高于室外浓度
D. 室内浓度往往与室外浓度无关
E. 室内浓度往往与室外其他污染物浓度有关

正确答案：C。室内浓度往往是高于室外浓度

解析：本题考查室内外共存同类污染物对室内空气的污染。室内外共存同类污染物发生源时，该污染物的浓度往往是室内高于室外（C对ABDE错）。